粗死亡率这一指标的高低
A. 受人口年龄构成影响不大
B. 受人口年龄构成影响大
C. 能用来评价一个国家的卫生文化水平
D. 可以精确地反映人口的死亡水平
E. 可反映某人群主要的死亡原因

正确答案：B。受人口年龄构成影响大